将离体小肠置于适宜的环境中仍然进行很好的节律性收缩运动，表明小肠平滑肌
A. 传导性好
B. 有自律性
C. 伸展性好
D. 收缩性强
E. 兴奋性高

正确答案：B。有自律性